女性，25岁。上前牙咀嚼不适2个月余。口腔检查：左上2远中邻腭面深龋，穿髓，探诊（-），叩诊（±），牙髓活力电测验（-），牙周检查（-）。X线片示：根尖有边界不清楚的透影区，呈云雾状。其最佳治疗方法是
A. 干髓术
B. 塑化治疗
C. 根管治疗
D. 拔髓术
E. 牙髓切断术

正确答案：C。根管治疗

解析：本题考查根管治疗的适应证。女性，25岁。上前牙咀嚼不适2个月余。口腔检查：左上2远中邻腭面深龋，穿髓，探诊（-），叩诊（±），牙髓活力电测验（-），牙周检查（-）。X线片示：根尖有边界不清楚的透影区，呈云雾状。其最佳治疗方法是根管治疗（C对）。患者左上2远中邻腭面深龋，穿髓，探诊（-），牙髓活力电测验（-），表明牙髓已经坏死；根尖有边界不清楚的透影区，呈云雾状，表明该患牙患有慢性根尖周脓肿。对于有牙髓坏死和根尖周病的患牙，髓腔内除了含有坏死感染牙髓的残余，还有大量细菌及其毒性产物，必须施行根管治疗以彻底清理感染根管内的炎症牙髓和坏死物质。干髓术（A错）适用于成年人后牙牙髓早期病变（即牙髓尚未化脓、坏死）不能保存活髓者，也适用于乳牙牙髓炎牙根已形成但尚未发生吸收者，因该患者左上2牙髓已坏死，故不宜行干髓术。塑化治疗（B错）是将未聚合的塑化剂注入根管内，使之渗透到残存的牙髓组织及髓腔内感染物中，和这些物质一齐聚合，达到消除病原刺激物的作用，塑化剂聚合前有良好的流动性，故应选有明确狭窄区且未遭破坏的根管，因其可致牙体变色且对软组织有一定的刺激性，故从美观考虑多适用于后牙，可用于桩冠修复前的根管封闭，目前临床上已很少使用。拔髓术（D错）是将全部牙髓摘除，再将髓腔用根管充填材料严密充填，保留患牙的一种方法，牙髓摘除术适用于各种牙髓炎，但仅是对牙髓进行处理，对于同时存在根尖周病的患牙治疗效果不如根管治疗术。牙髓切断术（E错）是切除炎症牙髓组织，以盖髓剂覆盖于牙髓断面，保留正常牙髓组织的方法，该患牙牙髓已坏死，故不适用于牙髓切断术。